下列药物联合应用合理的是
A. 异烟肼和对氨基水杨酸
B. 普鲁卡因和磺胺嘧啶
C. 青霉素和庆大霉素
D. 青霉素和四环素
E. 青霉素和丙磺舒

正确答案：A、C、E。异烟肼和对氨基水杨酸；青霉素和庆大霉素；青霉素和丙磺舒

解析：本题考查药物的联合应用。下列药物联合应用合理的是异烟肼和对氨基水杨酸（A对）、青霉素和庆大霉素（C对）、青霉素和丙磺舒（E对）。对氨基水杨酸与异烟肼合用时竞争同一酶系，使后者代谢减少，游离型药物增多，作用增强。青霉素与庆大霉素合用，可产生增强作用。青霉素与丙磺舒合用，后者可与青霉素竞争从肾小管分泌，从而阻碍青霉素自肾排出，以提高青霉素的血药浓度，延长维持时间。普鲁卡因在体内水解产生对氨基苯甲酸，可降低磺胺嘧啶的疗效，不宜联合使用（B错）。四环素为速效抑菌剂，与青霉素合用时，只有抑制作用，青霉素难以发挥作用（D错）。